下列备洞原则中哪项是错的
A. 尽可能去除龋坏组织
B. 底平壁直、点线角清晰
C. 边缘外形线应备成圆缓曲线
D. 洞壁无倒凹
E. 作预防性扩展

正确答案：D。洞壁无倒凹

解析：本题考查备洞原则。洞壁可备倒凹，加强固位，防止充填体脱落（D错，为本题的正确答案）。窝洞预备的基本原则要去净龋坏组织，防止充填后产生继发龋（A对）。盒状洞形是窝洞基本的抗力形，底平壁直，使咬合力分布均匀，清晰圆钝的点线角使应力向四周传递，同时有利于充填材料的填入（B对）。窝洞边缘外形线应备成圆缓曲线，防止应力集中而使牙齿折裂（C对）。邻面龋应作预防性扩展（E对），洞缘扩展到接触区以外的自洁区，防止继发龋和消除无基釉。